女性，30岁，反复发作性呼吸困难，胸闷2年。3天前受凉后咳嗽，咳少量脓痰，接着出现呼吸困难胸闷，并逐渐加重。体检：无发绀，双肺广泛哮鸣音，肺底部少许湿啰音。该病例最可能的诊断是
A. 支气管哮喘
B. 心源性哮喘
C. 慢性喘息型支气管炎
D. 慢性阻塞性肺疾病（红喘型）
E. 慢性阻塞性肺疾病（紫肿型）

正确答案：A。支气管哮喘

解析：患者为青年女性，有反复发作性的呼吸困难和胸闷，受冷空气的刺激后，症状加重，双肺闻及广泛的哮鸣音（为支气管哮喘的典型体征），考虑为支气管哮喘（A对），且为胸闷变异性哮喘（以胸闷为唯一症状的不典型哮喘称胸闷变异性哮喘）。心源性哮喘（B错）（即左心衰引起的呼吸困难）发作时症状与支气管哮喘相似，但多见于器质性心脏病患者，发作时必须坐起，重症者肺部有干湿性啰音，甚至咳粉红色泡沫状痰。慢性喘息型支气管炎（C错）多见于中老年，为慢性过程（每年发作持续＞3月，连续2年或2年以上），与本病例不符。慢性阻塞性肺疾病（红喘型）和慢性阻塞性肺疾病（紫肿型）（DE错）以持续、进行性发展的气流受限为特征，表现为慢性咳嗽、咳痰、喘息等，肺部听诊可出现呼吸音减弱，呼气期延长，部分患者可闻及湿性啰音和（或）干性啰音，与本病例不符。慢性阻塞性肺疾病红喘型又称气肿型、A型；慢性阻塞性肺疾病紫肿型又称支气管炎型、B型，此分型九版内科学已删除。